某研究员在其发表的一篇论文中使用了他人的部分图表及数据，但未加注明，后被杂志社撤稿。该研究员的做法违背的医学科研伦理要求是
A. 知情同意
B. 敢于怀疑
C. 知识公开
D. 诚实严谨
E. 团结协作

正确答案：D。诚实严谨

解析：本题考查医学科研伦理的要求。某研究员在其发表的一篇论文中使用了他人的部分图表及数据，但未加注明，后被杂志社撤稿。该研究员的做法违背的医学科研伦理要求是诚实严谨（D对）。医学科研伦理的要求：（一）动机纯正、（二）诚实严谨、（三）敢于怀疑、（四）公正无私、（五）团结协作、（六）知识公开。根据题目中的信息可知，该研究员的做法违背的医学科研伦理要求是诚实严谨。